最容易污染海产食品的细菌是
A. 沙门氏菌
B. 副溶血性弧菌
C. 伤寒杆菌
D. 霍乱弧菌
E. 志贺氏菌

正确答案：B。副溶血性弧菌

解析：本题考查最容易污染海产食品的细菌。最容易污染海产食品的细菌是副溶血性弧菌（B对ACDE错），它是引起夏秋季节食物中毒的重要原因。